男性，26岁，与其父吵架后服敌敌畏，30分钟后被家人送到医院，神志清楚，治疗过程中最重要的措施是
A. 静脉注射安定
B. 应用阿托品
C. 应用解磷定
D. 应用水合氯醛
E. 彻底洗胃

正确答案：E。彻底洗胃

解析：青年男性患者口服敌敌畏30分钟后入院，神志清楚，首选的治疗方案是彻底洗胃（E对）清除体内尚未吸收的毒物。阿托品（B错）、解磷定（C错）为敌敌畏治疗的解毒药物，此时患者服药仅30分钟，且未出现症状，最重要的是要减少胃肠道毒物吸收。安定（A错）、水合氯醛（D错）一般不用于有机磷中毒（敌敌畏）的治疗。